女，63岁。自述绝经后阴道不规则出血，近两月阴道排液增多，呈血性。妇科检查示宫颈管肥大，触之易出血。初步诊断为“宫颈癌”。确诊最可靠的方法是
A. 宫颈刮片细胞学检查
B. 宫颈和宫颈管活组织检查
C. 碘试验
D. B型超声检查
E. MRI

正确答案：B。宫颈和宫颈管活组织检查

解析：患者为老年女性，绝经后出现阴道不规则流血，近两月阴道排液增多，呈血性。妇科检查示宫颈管肥大，触之易出血。初步诊断为“宫颈癌”，为明确诊断最可靠的方法是宫颈和宫颈管活组织检查（B对）。确诊后根据具体情况选择B型超声（D错）或MRI（E错）等影像学检查。宫颈刮片细胞学检查（P405）（A错）是筛查早期子宫颈癌的重要方法。宫颈碘试验（P444）（C错）是用复方碘溶液棉球浸湿宫颈，富含糖原的成熟鳞状上皮细胞被碘染成棕褐色，称为碘试验阳性；柱状上皮、未成熟化生上皮、角化上皮及不典型增生上皮不含糖原，涂碘后均不着色，称为碘实验阴性。其主要用于定位可疑病变区域，无诊断意义。